下列表现最能提示非肾小球源性血尿的是
A. 尿红细胞呈多形性
B. 伴大量蛋白尿
C. 尿沉渣镜检可见红细胞管型
D. 尿潜血阳性
E. 终末血尿

正确答案：E。终末血尿

解析：终末血尿（E对）为排尿终了时尿中有血，多提示患者膀胱颈、膀胱三角区、前列腺等部位存在病变。尿红细胞呈多形性（A错）、伴大量蛋白尿（D错）和（或）管型尿（特别是红细胞管型）（C错），多提示为肾小球源性血尿，系肾小球滤过膜病变，红细胞漏出挤压破裂，蛋白质渗出所致。